在病人常见的心理问题中，常表现为行为与年龄社会角色不相符合，想回到婴儿时期，此病人的心理状态被称为
A. 焦虑
B. 回避
C. 猜疑
D. 愤怒
E. 退化

正确答案：E。退化

解析：退化（E对）是个体经历创伤事件，成人式解决问题的态度和方法，表现出不成熟的应对方式，退行至小孩的阶段。退行常伴有依赖心理和行为，如就地打滚，退化到孩子的反应方式。焦虑（A错）是当个体预感危机来临或预期事物的不良后果时出现紧张不安，急躁、担忧的情绪状态。回避（B错）指预先知道应激源会出现，而提前远离，如拖延、闭门不出、离家出走、离校、辞职等。猜疑（C错）是指没有根据地怀疑别人，怀疑别人做事针对自己。愤怒（D错）是指病人往往认为自己得病是不公平的、倒霉的，再加上疾病的痛苦，使病人感到愤怒：同时，由于各种原因使病人的治疗受阻或病情恶化，或发生医患冲突，都会使病人产生愤怒情绪。